属于二级保护野生药材物种且是毒性药材的是
A. 羚羊角
B. 石斛
C. 蛤蚧
D. 蟾酥
E. 斑蝥

正确答案：D。蟾酥

解析：本题考查野生药材物种。属于二级保护野生药材物种且是毒性药材的是蟾酥（D对）。二级保护野生药材物种系指分布区域缩小，资源处于衰竭状态的重要野生药材物种。二级保护药材名称：鹿茸（马鹿）、麝香（3个品种）、熊胆（2个品种）、穿山甲、蟾酥（2个品种）、哈蟆油、金钱白花蛇、乌梢蛇、蛤蚧（C错）、甘草（3个品种）、黄连（3个品种）、人参、杜仲、厚朴（2个品种）、黄柏（2个品种）、血竭。毒性药品中药品种共27种：砒石（红砒、白砒）、砒霜、水银、生马钱子、生川乌、生草乌、生白附子、生附子、生半夏、生南星、生巴豆、斑蝥（E错）、青娘虫、红娘子、生甘遂、生狼毒、生藤黄、生千金子、生天仙子、闹羊花、雪上一枝蒿、白降丹、蟾酥、洋金花、红粉、轻粉、雄黄。一级保护野生药材物种系指濒临灭绝状态的稀有珍贵野生药材物种。羚羊角（A错）为一级保护野生药材物种。三级保护野生药材物种系指资源严重减少的主要常用野生药材物种。石斛（B错）属于三级保护野生药材物种。